某男，57岁。自诉眩晕，动则加剧，常因劳累而加重，心悸少寐，入睡困难，神疲懒言，食欲不振，面色无华，舌淡，脉细弱。宜选用的方剂是
A. 朱砂安神丸加减
B. 涤痰汤加减
C. 归脾汤加减
D. 杞菊地黄丸加减
E. 生脉散加减

正确答案：C。归脾汤加减

解析：本题考查的是眩晕的辨证论治。诉眩晕，动则加剧，常因劳累而加重，心悸少寐，入睡困难，神疲懒言，食欲不振，面色无华，舌淡，脉细弱。宜选用的方剂是归脾汤加减（C对）。眩晕是以头晕、眼花为主症的疾病。轻者闭目即止，重者如坐车船，旋转不定，不能站立，或伴恶心、呕吐、汗出、面色苍白等症，甚则突然晕倒。西医学的耳性眩晕（梅尼埃病、耳石症、晕动病）、脑性眩晕（椎-基底动脉供血不足、脑动脉粥样硬化）、颈源性眩晕（椎动脉型颈椎病）以及其他原因（血压异常、神经症、眼部疾患及外伤等）所致眩晕，均可参考此处辨证论治。（一）肝阳上亢证：【症状】眩晕，耳鸣，头目胀痛，口苦，失眠多梦，遇烦劳郁怒而加重，颜面潮红，急躁易怒。舌红苔黄，脉弦或数。【方剂应用】基础方剂为天麻钩藤饮（天麻、钩藤、生石决明、川牛膝、桑寄生、杜仲、栀子、黄芩、益母草、朱茯神、夜交藤）加减。（二）气血亏虚证：【症状】眩晕动则加剧，劳累即发，面色淡白，神疲乏力，倦怠懒言，唇甲不华，发色不泽，心悸少寐，纳少腹胀。舌淡苔薄白，脉细弱。【方剂应用】基础方剂为归脾汤（人参、黄芪、白术、茯神、龙眼肉、酸枣仁、木香、当归、远志、生姜、大枣、甘草）加减。（三）肾精不足证：【症状】眩晕日久不愈，精神萎靡，两目干涩，视力减退，腰膝酸软，或遗精滑泄，耳鸣齿摇，颧红咽干，五心烦热。舌红少苔，脉细数。【方剂应用】基础方剂为左归丸（熟地黄、山药、山茱萸、菟丝子、枸杞子、川牛膝、鹿角胶、龟板胶）加减。（四）痰湿中阻证：【症状】眩晕，头重昏蒙，或伴视物旋转，胸闷恶心，呕吐痰涎，食少多寐。舌苔白腻，脉濡。【方剂应用】基础方剂为半夏白术天麻汤（半夏、白术、天麻、橘红、茯苓、甘草、生姜、大枣）加减。朱砂安神丸（A错）为心悸阴虚火旺证的中成药应用。心悸阴虚火旺证：【症状】心悸易惊，心烦失眠，五心烦热，口干，盗汗，思虑劳心则症状加重，伴耳鸣腰酸，头晕目眩，急躁易怒。舌红少津，苔少或无，脉细数。【中成药应用】常用中成药有天王补心丸（水蜜丸）、朱砂安神片、宁神补心片、安神补心丸。涤痰汤加减（B错）为胸痹痰浊痹阻证的方剂应用。胸痹痰浊痹阻证：【症状】胸闷重而心痛微，痰多气短，肢体沉重，形体肥胖，遇阴雨天而易发作或加重，伴有倦怠乏力，纳呆便溏，咳吐痰涎。舌体胖大且边有齿痕，苔浊腻或白滑，脉滑。【方剂应用】基础方剂为瓜蒌薤白半夏汤（瓜蒌、薤白、半夏、白酒）合涤痰汤（制半夏、制南星、陈皮、枳实、茯苓、人参、石菖蒲、竹茹、甘草、生姜）加减。杞菊地黄丸（D错）：【药物组成】熟地黄、酒萸肉、山药、枸杞子、菊花、茯苓、泽泻、牡丹皮。【功能】滋肾养肝。【主治】肝肾阴亏，眩晕耳鸣，羞明畏光，迎风流泪，视物昏花。生脉散加减（E错）为胸痹气阴两虚证的方剂应用。胸痹气阴两虚证：【症状】胸闷隐痛，时作时止，心悸气短，动则益甚，伴倦怠懒言，易汗出，头晕，失眠多梦。舌红或淡红，舌体胖且边有齿痕，苔薄白或少，脉细缓或结代。【方剂应用】基础方剂为生脉散（人参、麦冬、五味子）合人参养荣汤（人参、熟地黄、当归、白芍、白术、茯苓、黄芪、陈皮、五味子、桂心、远志、炙甘草）加减。